颌面部创伤后抗休克治疗措施不包括
A. 安静、止痛
B. 降低颅内压
C. 维持血压
D. 补液
E. 止血

正确答案：B。降低颅内压

解析：本题考查创伤性休克的治疗措施。颌面部创伤后抗休克治疗措施不包括降低颅内压（B错，为本题的正确答案）。创伤性休克是由于机体遭受暴力作用后，发生了重要脏器损伤、严重出血等情况，使患者有效循环血量锐减，微循环灌注不足；以及创伤后的剧烈疼痛、恐惧等多种因素综合形成的机体代偿失调的综合征。其处理原则是：①安静、镇痛（A对）。②止血（E对）和补液（D对）：由于患者遭受创伤后，严重出血，有效循环锐减，微循环不足，应恢复组织灌流量。③维持血压稳定（C对），维持颅内压，减轻休克症状。